中毒可致肾小管坏死引起急性肾衰的中药是
A. 天仙藤
B. 忍冬藤
C. 大血藤
D. 首乌藤
E. 鸡血藤

正确答案：A。天仙藤

解析：本题考查的是对肾功能有影响的中药。中毒可致肾小管坏死引起急性肾衰的中药是天仙藤（A对）。常见对肾功能有影响的中药：1.植物类：（1）含生物碱类：近年来发现，不但雷公藤、草乌、益母草、蓖麻子、麻黄、北豆根等均可导致急性肾功能衰竭，而且含上述中药的一些制剂也可引起肾损害甚至急性肾功能衰竭。（2）含马兜铃酸类：马兜铃、天仙藤、寻骨风等均含马兜铃酸，中毒可致肾小管坏死出现面部浮肿，渐至全身水肿、尿频尿急，甚至出现急、慢性肾功能衰竭及尿毒症而死亡。（3）含挥发油类：部分芳香类药物的肾毒性可能与其挥发油类成分相关，如土荆芥、藿香、茵陈、艾叶等。（4）含蒽醌类：研究显示，大黄蒽醌类成分（大黄、番泻叶、芦荟）具有潜在的肝肾毒性和致癌性。（5）苷类：苍耳子含苍术苷或羧基苍术苷可导致近端肾小管坏死、肝中心小叶坏死。2.动物类：（1）斑蝥：斑蝥的肾毒性极强，主要含有斑蝥酸酐，超量内服、外用或制药不慎均可引起中毒。（2）鱼胆：鱼胆含有胆汁毒素，可降低肝、肾、脑等脏器中细胞色素氧化酶活性，抑制细胞的氧化磷酸化，造成肝、肾、脑的细胞广泛中毒坏死。（3）海马：煎服偶可引起皮肤紫斑、蛋白尿及肾功能减退。（4）其他：蜈蚣、蜂毒等也具肾毒性，应用时要严格限制剂量。3.矿物类：（1）含砷类：砒石、砒霜、雄黄、红矾，以及中成药牛黄解毒片、安宫牛黄丸、牛黄清心丸、六神丸、砒枣散等，均含砷元素，服用后使中枢神经中毒，产生一系列中毒症状，临床表现有剧烈恶心、呕吐、腹痛、腹泻等消化系统症状和转氨酶升高、黄疸、血尿、蛋白尿等肝肾功能损害。（2）含汞类：朱砂、升汞、轻粉、红粉，以及中成药安宫牛黄丸、牛黄清心丸、朱砂安神丸、天王补心丸、安神补脑丸、苏合香丸、人参再造丸、大活络丸、七厘散、梅花点舌丸、一捻金（胶囊）等，均含汞元素。过量服用可产生各种中毒症状。泌尿系统表现为少尿、蛋白尿，严重者可致急性肾功能衰竭。